按升降浮沉理论，具有升浮和沉降二向性的中药是
A. 桔梗
B. 白前
C. 前胡
D. 紫苏
E. 黄连

正确答案：C。前胡

解析：本题考查的是药物的升降沉浮效用。按升降浮沉理论，具有升浮和沉降二向性的中药是前胡（C对）。升降浮沉，即指药物在人体的作用趋向。药物的临床疗效是确定其升降浮沉的主要依据。病势趋向常表现为向上、向下、向外、向内，病位常表现为在上、在下、在外、在里；能够针对病情，改善或消除这些病证的药物，相对也具有向上、向下、向里、向外的不同作用趋向。如白前（B错）能祛痰降气，善治肺实咳喘、痰多气逆，故性属沉降；桔梗（A错）能开提肺气、宣肺利咽，善治咳嗽痰多、咽痛音哑，故性属升浮。有些药还表现为升浮与沉降皆具的二向性，如胖大海，既能清宣肺气、利咽而具升浮之性，又能清热解毒、通便而具沉降之性；前胡，既能降气祛痰而显沉降性，又能宣散风热而显升浮性；等等。紫苏（D错）辛温发散，属升浮。黄连（E错）苦寒清泻，属沉降。